患者慢性膀胱刺激征，静脉造影显示右上盏破坏，下列哪个疾病最有可能
A. 膀胱炎
B. 肾结核
C. 膀胱肿瘤并感染
D. 肾盂肾炎
E. 膀胱结石

正确答案：B。肾结核

解析：患者慢性膀胱刺激征（提示可能有泌尿系感染），静脉造影显示右上盏破坏（肾结核的早期表现），结合患者临床表现和相关检查，最可能的诊断是右肾结核（B对）。膀胱炎（A错）所致上尿路感染一般先累及肾盂再逐渐累及到肾盏，静脉造影不会只有右肾上盏局部的破坏改变。膀胱肿瘤（C错）的典型表现为间歇性、全程无痛性肉眼血尿，合并感染时可出现膀胱刺激征，病变一般不会累及肾脏。肾盂肾炎（D错）主要表现为发热、腰痛及膀胱刺激症状等。膀胱结石（E错）典型表现为排尿突然中断，疼痛放射至远端尿道及阴茎头部，伴排尿困难和膀胱刺激征，一般不会出现肾盏的改变。